碱性药物的解离度与药物的pKₐ和液体pH的关系式为lg[B]/[HB⁺]=pH-pKₐ，某药物的pKₐ=8.4，在pH7.4生理条件下，以分子形式存在的比
A. 1%
B. 10%
C. 50%
D. 90%
E. 99%

正确答案：B。10%

解析：本题考查药物的酸碱性对药效的影响。由题已知：pKₐ=8.4，pH7.4。根据公式碱性药物：lg[B]/[HB⁺]=pH-pKₐ，lg[B]/[HB⁺]=pH-pKₐ=7.4-8.4=-1，又因为lg1/10=-1 ，所以答案为10%（B对）。